蒺藜性平，有小毒，其不具有的功效是
A. 平肝
B. 疏肝
C. 潜阳
D. 祛风明目
E. 散风止痒

正确答案：C。潜阳

解析：本题考查蒺藜的功效。蒺藜性平，有小毒，其不具有的功效是潜阳（C错，为本题正确答案）。蒺藜【功效】平肝（A对），疏肝（B对），祛风明目（D错），散风止痒（E对）。